疾病发生的内在根据是
A. 地域因素
B. 正气不足
C. 邪气侵害
D. 环境因素
E. 气候因素

正确答案：B。正气不足

解析：正气强弱是决定发病与否的关键因素和内在根据（B对）；邪气是发病的重要条件，不是内在根据（C错）；地域因素、气候因素、环境因素是影响发病的因素，不是疾病发生的内在根据（ADE错）。